属于唾液中分泌型IgA的主要来源
A. 唇腺
B. 舌下腺
C. 腭腺
D. 下颌下腺
E. 腮腺

正确答案：A。唇腺

解析：唇腺纤维结缔组织中的浆细胞分泌IgA，并与腺细胞分泌的分泌片结合形成分泌型IgA，排入口腔，具有免疫作用。唇腺是唾液分泌型IgA的主要来源，其浓度比腮腺高4倍。掌握“唾液腺组织学特点”知识点。